10岁男孩，一年来时有尿频、尿急、尿痛和排尿困难，尿流中断，改变体位后又能继续排尿，首先应考虑
A. 急性膀胱炎
B. 前列腺炎
C. 尿道狭窄
D. 膀胱结石
E. 输尿管结石

正确答案：D。膀胱结石

解析：男性患儿，有尿频、尿急、尿痛（膀胱刺激症状），排尿困难尿流中断，改变体位后又能继续排尿（膀胱结石典型表现），结合患者病史和临床表现，首先应考虑膀胱结石（D对）。急性膀胱炎（A错）常表现为尿频、尿急、尿痛的膀胱刺激征，无排尿中断。前列腺炎（B错）常表现为突发寒战、高热、膀胱刺激症状和排尿困难，改变体位后排尿困难症状不能缓解。尿道狭窄（C错）常表现为排尿困难，多有尿道外伤或感染史。输尿管结石（E错）典型表现为肾绞痛、血尿，一般无膀胱刺激症状。